牙胚分裂容易引起
A. 先天性缺失
B. 乳牙滞留
C. 乳牙迟萌
D. 乳牙早萌
E. 多生牙

正确答案：E。多生牙

解析：本题考查多生牙的病因。牙胚分裂容易引起多生牙（E对）。多生牙即额外牙，病因至今仍未明确。对额外牙形成的原因有数种推测：①进化过程中的返祖现象。②牙胚的分裂是额外牙发生的可能致病因素。③牙板局部的活性亢进是解释额外牙发生理论中最被广泛接受的，即牙板局部的活性过强导致了额外牙的形成。个别牙和多数牙先天缺失（A错）的病因尚未明确，有学者认为遗传因素或胚胎早期受有害物质影响可能导致牙板生成不足或牙胚增殖受到抑制，从而导致牙齿缺失。乳牙滞留（B错）的病因包括：承恒牙萌出方向异常，使乳牙牙根未吸收或吸收不完全；继承恒牙先天缺失、埋伏阻生、异位萌出，不能促使乳牙脱落；继承恒牙萌出无力，乳牙根不被吸收；或全身因素，如佝偻病、侏儒症、外胚叶发育异常、锁骨颅骨发育不全，以及某些遗传因素等。多数或全部乳牙滞留的原因目前尚不清楚。全口或多数乳牙萌出过迟（C错）或萌出困难多与全身因素有关。如佝偻病、甲状腺功能减退以及营养缺乏等，佝偻病患儿的乳牙能迟至出生后14～15个月才开始萌出，并往往伴有牙釉质、牙本质发育异常。乳牙早萌（D错）的原因不甚了解，一种说法是由于牙胚距口腔黏膜很近，而过早萌出。也有人认为可能与种族特性有关，如美国黑人比白人的婴儿乳牙早萌的发生率高。